患儿着凉感冒后胸闷气短，恶心呕吐，心悸，乏力，低热，心率快，心音低钝，心肌酶升高，心电图示ST段抬高，低电压，下列处理错误的是
A. 安静卧床
B. 避免情绪波动
C. 予以易消化富营养饮食
D. 加强体育锻炼，增加运动量
E. 营养心肌，改善心肌代谢，稳定心功能

正确答案：D。加强体育锻炼，增加运动量

解析：据患儿发病前有受凉感冒的病史，出现胸闷、心悸、乏力等症状，结合心电图及心肌酶结果，故初步诊断病毒性心肌炎。病毒性心肌炎临床表现为：症状表现轻重不一，取决于年龄和感染的急性或慢性过程；大部分患儿在心脏症状出现前有呼吸道或肠道感染症状，继而出现心脏症状，主要表现为明显乏力，食欲不振，面色苍白，多汗，心悸，气短，头晕，手足凉等；体征为心尖区第一音低钝，部分有奔马律，心界明显扩大；危重病例可见脉搏微弱及血压下降，两肺出现湿啰音及肝、脾肿大；实验室检查：血清酶的测定：血清谷草转氨酶、乳酸脱氢酶、α-羟丁酸脱氢酶、肌酸磷酸激酶及同功酶在急性期均可升高。CK-MB血清水平升高对心肌损伤诊断意义较大；心电图：常见ST段偏移，T波低平、双向或倒置；Q-T间期延长；各种心律失常，如窦房、房室、室内传导阻滞，过早搏动，阵发性心动过速及心房扑动或颤动等；慢性病例可见左心室肥厚。西医治疗：①急性期需卧床休息（A对），以减轻心脏负荷，选项加强体育锻炼，增加运动量会加重心肌受损的程度（D错，为本题正确答案）；②营养心肌：泛醌（CoQ10）和1，6-二磷酸果糖具有改善心肌细胞代谢作用；③大剂量维生素C及能量合剂：维生素C能清除自由基，改善心肌代谢，有助于心肌炎的恢复；能量合剂具有营养心肌，改善心肌代谢作用（E对）。避免情绪波动（B对）以减轻心脏负担，减少心肌耗氧量。予以易消化富营养饮食（C对）属常规饮食护理。